进行江河水系监测时，自净断面可设置在
A. 污染源上游
B. 污染源上游定距离
C. 污染源下游
D. 污染断面下游一定距离
E. 远离污染源的河中心

正确答案：D。污染断面下游一定距离

解析：本题考查江河水系监测的相关内容。调查水系的水质状况，应在河段至少设置3个采样断面：①设在污染源的上游清洁或对照断面，可了解河水未受本地区污染时的水质状况；②设在污染源的下游的污染断面，可了解水质污染状况和程度；③设在污染断面下游一定距离（D对ABCE错）的自净断面，可了解污染范围及河水的自净能力。